脊髓前角运动神经元的胞体或轴突损伤，会造成其所支配的
A. 对侧骨骼肌的肌张力减弱，腱反射消失
B. 同侧骨骼肌的肌张力减弱，腱反射消失
C. 同侧骨骼肌的肌张力减弱，腱反射亢进
D. 同侧骨骼肌的肌张力加强，腱反射亢进
E. 对侧骨骼肌的肌张力加强，腱反射亢进

正确答案：C。同侧骨骼肌的肌张力减弱，腱反射亢进

解析：脊髓前角运动神经元的胞体或轴突损伤会造成上运动神经元损伤。上运动神经元损伤后的瘫痪特点表现为：随意运动障碍；肌张力增高，故称痉挛性瘫痪（硬瘫）；深反射亢进（因失去高级控制），浅反射（如腹壁反射、提睾反射等）减弱或消失（因锥体束的完整性被破坏）（C对）。